执业药师的义务包括
A. 了解与执业相关的法律变化
B. 积极参与相关法律、法规、规章的制定、修订过程
C. 向公众宣传医药保健及法律知识
D. 不断提高自身的药学专业素质、法律和道德素质
E. 积极向患者宣传、推荐厂商的药品及保健品

正确答案：A、B、C、E。了解与执业相关的法律变化；积极参与相关法律、法规、规章的制定、修订过程；向公众宣传医药保健及法律知识；积极向患者宣传、推荐厂商的药品及保健品